关于信息偏倚的控制方法，说法正确的是
A. 制定严格的研究对象人选条件
B. 在与病例相同的多个医院选择多病种对照
C. 采用盲法进行调查
D. 采用匹配方法选择研究对象
E. 资料分析阶段采用分层分析

正确答案：C。采用盲法进行调查

解析：本题考查信息偏倚的控制方法。信息偏倚又称观察偏倚或测量偏倚，是在收集整理信息过程中由于测量暴露与结局的方法有缺陷造成的系统误差。其控制方法有：1.研究者对拟进行的研究要制定明细的资料收集方法和严格的质量控制方法；2.尽可能采用“盲法”收集资料（C对ABDE错）；3.尽量采用客观指标的信息；4.在调查询问研究对象的远期暴露史时，由于记忆力的限制，很难避免回忆偏倚；5.资料的校正。